分泌促激素的内分泌腺为
A. 甲状旁腺
B. 肾上腺
C. 胰腺
D. 垂体
E. 无

正确答案：D。垂体

解析：垂体（D对）分为腺垂体和神经垂体两部分，其中腺垂体可分泌促激素（促甲状腺激素、促肾上腺皮质激素、促性腺激素）。